外来化合物的概念是
A. 与人类接触并进入机体
B. 存在于人类生活和外界环境中
C. 具有生物活性
D. 并非人体成分和营养物质
E. 以上都是

正确答案：E。以上都是